属于高渗性缺水，错误的是
A. 血钠浓度在150mmol/L以上
B. 治疗可补充0.45%氯化钠溶液
C. 缺水多于缺钠
D. 常有烦躁不安
E. 常见病因有肠外瘘

正确答案：E。常见病因有肠外瘘

解析：本题考查高渗性缺水。属于高渗性缺水，错误的是常见病因有肠外瘘（E错，为本题的正确答案）。常见病因有肠外瘘可见于等渗性缺水，因消化液的急性丧失，造成水和钠成比例地丧失。高渗性缺水有水和钠的同时丢失，但缺水多于缺钠（C对），故血清钠高于正常范围，血钠浓度升高至150mmol/L以上（A对），细胞外液的渗透压升高。高渗性缺水的主要病因有①摄入水分不够，如食管癌致吞咽困难，重危病人的给水不足，经鼻胃管或空肠造瘘管给予高浓度肠内营养溶液等；②水分丧失过多，如高热大量出汗（汗中含氯化钠0.25%）、大面积烧伤暴露疗法、糖尿病未控制致大量尿液排出等。临床表现因缺水程度不同，症状亦不同，中度缺水者常有烦躁不安（D对）。治疗时解除病因同样具有治疗的重要性，无法口服的病人，可静脉滴注5%葡萄糖溶液或低渗的0.45%氯化钠溶液（B对），补充已丧失的液体。